有关治疗三叉神经痛的药物封闭疗法，错误的是
A. 适用于疼痛重的患者
B. 适用于口服药物无效者
C. 是短期治疗方法
D. 封闭药物的浓度要高于阻滞麻醉
E. 注射时应注意无菌操作

正确答案：D。封闭药物的浓度要高于阻滞麻醉

解析：本题考查治疗三叉神经痛的药物封闭疗法。有关治疗三叉神经痛的药物封闭疗法，错误的是封闭药物的浓度要高于阻滞麻醉（D错，为本题的正确答案）。三叉神经痛药物封闭疗法选用1～2%的利多卡因，利多卡因在行阻滞麻醉时，也是选用1～2%。也可加入维生素B₁₂，同时操作过程中也要符合无菌操作的原则（E对）。三叉神经痛封闭治疗适用于疼痛重（A对）、药物治疗无效（B对）的初发患者的短期治疗（C对）。